在某工地食堂用餐过后半小时左右，有多名工人口唇、指甲和全身皮肤出现发绀，并有精神萎靡、头晕、头痛、乏力、心跳加速。有的伴有恶心、呕吐、腹胀、烦躁不安、呼吸困难。其最大可能是
A. 河豚鱼中毒
B. 四季豆中毒
C. 亚硝酸盐中毒
D. 沙门菌中毒
E. 葡萄球菌肠毒素中毒

正确答案：C。亚硝酸盐中毒